王某1997年于中医药大学毕业分配到市级中医院工作，并于1998年取得了中医师执业资格，《中华人民共和国执业医师法》施行当年，其依照有关开办医疗机构的规定申请个体开业。依据我国执业医师法的规定，卫生行政部门应
A. 批准其个体行医资格申请
B. 要求其应具备主治医师资格
C. 要求其参加国家临床中医专业技术资格考试
D. 要求其能保证个体行医质量，才能予以受理申请
E. 要求其经执业医师注册后在医疗机构中执业满5年

正确答案：E。要求其经执业医师注册后在医疗机构中执业满5年

解析：《中华人民共和国执业医师法》第十五条至第二十条规定：申请个体开业的执业医师要求其经执业医师注册后在医疗结构中执业满5年（E对）按照有关规定办理审批手续，才能行医。